丹毒的致病菌是
A. 大肠杆菌
B. 拟杆茵
C. 绿脓杆菌
D. β-溶血性链球菌
E. 金黄色葡萄球菌

正确答案：D。β-溶血性链球菌

解析：丹毒为β-溶血性链球菌（D对）感染所致，为急性非化脓性炎症。大肠杆菌（A错）多为肠源性感染的致病菌。拟杆菌（B错）为机会致病菌，为阑尾炎和败血症的常见菌。绿脓杆菌（C错）为多种化脓性感染的致病菌。金黄色葡萄球菌（E错）多为疖、痈的感染致病菌。